男，25岁。乏力、消瘦、腹胀2个月。查体：心肺未见异常，肝肋下1cm，脾肋下8cm。化验：Hb138g/L，WBC96×10⁹/L，Plt385×10⁹/L。分子生物检查可见bcr/abl融合基因。该患者的诊断是
A. 急性粒细胞白血病
B. 慢性淋巴细胞白血病
C. 慢性粒细胞白血病
D. 肝硬化、门静脉高压症
E. 急性淋巴细胞白血病

正确答案：C。慢性粒细胞白血病

解析：患者青年男性，乏力、消瘦、腹胀2个月，肝轻度肿大，脾肿大明显（慢粒患者常有乏力、消瘦等代谢亢进的症状，脾脏肿大明显，可引起腹胀），化验Hb138g/L（成年男性Hb正常值120～160g/L）正常，WBC96×10⁹/L（正常4～10×10⁹/L）明显增高，Plt385×10⁹/L（正常100～300×10⁹/L）升高（符合慢粒血象特点），分子生物检查可见bcr/abl融合基因（为慢粒特异性的分子生物学变化），故患者的诊断为慢性粒细胞白血病（C对）。急性粒细胞白血病（P571）（A错）常有发热、贫血、出血等症状，肝脾肿大多为轻至中度，血红蛋白、血小板常减少；慢性淋巴细胞白血病（P577）（B错）常有淋巴结肿大，脾脏轻至中度肿大，血象以淋巴细胞持续性增多为特征，可出现血小板减少和贫血；门静脉高压症（D错）为肝硬化的典型表现；急性淋巴细胞白血病（E错）（P571）多有淋巴结肿大，脾脏肿大不明显，多轻至中度。